学校卫生监督员必须经过什么机构聘任并发给监督员证书才能执行学校卫生监督任务
A. 县级以上卫生行政部门
B. 省级以上卫生行政部门
C. 县级以上教育行政部门
D. 省级以上教育行政部门
E. 省级以上卫生专业机构

正确答案：B。省级以上卫生行政部门